关于孕激素的生理作用，下列哪项不正确
A. 加快阴道上皮细胞脱落
B. 可抑制子宫收缩
C. 促进水、钠排泄
D. 抑制卵管平滑肌收缩
E. 黏液分泌增多

正确答案：E。黏液分泌增多

解析：孕激素的生理作用：①降低子宫平滑肌兴奋性及其对缩宫素的敏感性，抑制子宫收缩，有利于胚胎及胎儿在宫内生长发育；②使子宫内膜从增殖期转化为分泌期，为受精卵着床做准备；③使宫颈口闭合，黏液分泌减少，性状变黏稠；④抑制输卵管平滑肌节律性收缩频率和振幅；⑤加快阴道上皮细胞脱落；⑥促进乳腺小叶及腺泡发育；⑦孕激素在月经中期具有增强雌激素对垂体LH排卵峰释放的正反馈作用；在黄体期对下丘脑、垂体有负反馈作用，抑制促性腺激素分泌；⑧对下丘脑体温调节中枢有兴奋作用，可使基础体温在排卵后升高0.3～0.5℃，临床作为判定排卵日期标志之一；⑨促进水钠排泄。掌握“女性生殖系统生理”知识点。